男，50岁。咳嗽，间断咯血3个月，咳大量脓痰伴发热一周来诊。吸烟史30年。胸部X线片示左下肺阴影伴空洞，洞壁厚薄不一，有液平，诊断为肺脓肿。该患者应首先考虑的基础疾病是
A. 肺结核
B. 肺血管炎
C. 支气管肺癌
D. 支气管扩张
E. 支气管囊肿

正确答案：D。支气管扩张

解析：患者为中年男性，3个月前出现咳嗽、间断咯血，是支气管扩张典型的的临床表现（D对），1周前出现咳大量脓痰、发热，胸部X线片示左下肺阴影伴空洞，洞壁厚薄不一，有液平，提示继发感染导致继发性肺脓肿。肺结核（P65）（A错）常有低热、盗汗、乏力、消瘦等结核毒性症状，X线胸片特点是病变多发生在上叶的尖后段、下叶的背段和后基底段，呈多态性，即浸润、增殖、干酪、纤维钙化病变可同时存在，易形成空洞和播散病灶，结合痰结核菌检查可作出诊断。肺血管炎（B错）的全身症状包括发热、乏力、关节痛和皮损等。支气管肺癌（P79）（C错）X线胸片示空洞壁较厚，多呈偏心空洞，残留的肿瘤组织使内壁凹凸不平，空洞周围亦少炎症浸润，肺门淋巴结可有肿大。支气管肺囊肿（E错）X线检查可见多个边界纤细的圆形或椭圆形阴影，壁较薄，周围组织无炎症浸润，其病史和X线表现不符合本题描述。